国务院发布《医疗事故处理条例》施行于
A. 37135
B. 37500
C. 37865
D. 38231
E. 38596

正确答案：B。37500

解析：为了正确处理医疗事故，保护患者和医疗机构及其医务人员的合法权益，维护医疗秩序，保障医疗安全，促进医学科学的发展，2002年4月4日国务院发布了《医疗事故处理条例》，自2002年9月1日起施行。掌握“医疗事故处理概述、预防与处置”知识点。